使药物分子变大，不易转运的因素是
A. 首过效应
B. 与血浆蛋白结合
C. 血脑屏障
D. 胎盘屏障
E. 肝脏代谢

正确答案：B。与血浆蛋白结合

解析：使药物分子变大，不易转运的因素是与血浆蛋白结合（B对）。与血浆蛋白结合，是很多药物在血液中的存在形式，药物与血浆蛋白结合后，可以使药物分子变大，不利于其转运。首过效应（A错）是指药物在达到血液循环前被器官所代谢，导致最终进入血液循环的药量减少的现象，可影响药物的吸收。血脑屏障（C错）是脑组织内的毛细血管内皮细胞等组成的血液与脑脊液之间的屏障；胎盘屏障（D错）是胎盘绒毛与子宫血窦之间的屏障，两者影响药物的分布。肝脏代谢（E错）是药物常见的代谢方式。